以下哪项不属于中枢兴奋传播的特征
A. 双向传播
B. 中枢延搁
C. 兴奋的总和
D. 兴奋节律改变
E. 后发放

正确答案：A。双向传播